关于正确处理医务人员之间关系道德原则的表述有误的是
A. 共同维护病人利益和社会公益
B. 彼此平等，互相尊重
C. 彼此独立，互不干涉
D. 彼此信任、互相协作和监督
E. 互相学习、共同提高和发挥优势

正确答案：C。彼此独立，互不干涉